宜在医师指导下选用非处方补虚药的有
A. 体虚合并外感者
B. 体虚伴消耗性疾病者
C. 病情严重者
D. 儿童与老年人
E. 哺乳期妇女

正确答案：A、B、C、D、E。体虚合并外感者；体虚伴消耗性疾病者；病情严重者；儿童与老年人；哺乳期妇女